《咳论》“五脏六腑皆令人咳”，但关系最密切的是
A. 肺胃
B. 肺大肠
C. 心肺
D. 肺肾
E. 肺脾

正确答案：A。肺胃

解析：肺主皮毛，皮毛者，肺之合也，皮毛被感，先受风寒之邪，邪气在表，外束皮毛，皮毛闭敛，则肺气壅阻，缘肺合皮毛，表里同气，从其合也。再加以寒饮食入胃，寒气从肺脉上至于肺则肺寒，肺寒则饮食之寒与风露之寒外内合邪，因而客居肺部不散，寒闭气阻，则为肺咳（A对）。